关于生活饮用水水质标准的制定，错误的叙述是
A. 水质在流行病学上安全
B. 水中所含化学物质对人无害
C. 水的感官性状良好
D. 不适用于分散式供水
E. 经济技术上可行

正确答案：D。不适用于分散式供水

解析：本题考查生活饮用水水质标准的制定原则。在研究制定生活饮用水水质标准时，要求水中不得含有病原体，保证水在流行病学上的安全性（A对）；水中所含化学物质和放射性物质对人体健康无害（B对）；水的感官性状良好（C对）。此外，在选择指标和确定标准限值时要考虑经济技术上的可行性（E对）。不适用于分散式供水（D错，为本题正确答案）不属于生活饮用水水质标准的制定原则。